一种pH6.8的有机碱在消化道中最好的吸收部位是
A. 口腔
B. 胃
C. 十二指肠
D. 小肠
E. 结肠

正确答案：D。小肠